下列哪些药物可以用高氯酸滴定液进行非水溶液滴定
A. 枸橼酸钾
B. 盐酸麻黄碱
C. 重酒石酸去甲肾上腺素
D. 咖啡因
E. 异戊巴比妥

正确答案：A、B、C。枸橼酸钾；盐酸麻黄碱；重酒石酸去甲肾上腺素

解析：本题考查非水溶液滴定法。高氯酸滴定液是非水碱量法常用指示剂，此法可用来测定弱碱性药物及其盐类，例如，枸橼酸钾（A对）、盐酸麻黄碱（B对）、硫酸阿托品、马来酸氯苯那敏、重酒石酸去甲肾上腺素（C对）。